具有调经止痛作用，用于治疗妇女月经不调，痛经，乳房胀痛，应首选
A. 乌药
B. 枳实
C. 橘皮
D. 香附
E. 木香

正确答案：D。香附

解析：香附功效是疏肝解郁，理气宽中，调经止痛。香附疏肝理气，善调经止痛，为妇科调经的要药，用于治疗月经不调，经闭痛经，乳房胀痛（D对）。乌药（A错）辛温，能疏理气机，散寒止痛，善治三焦寒凝气滞疼痛。枳实（B错）既能破气除痞，又能消积导滞，用于治胃肠积滞，气机不畅者。橘皮（C错）温通苦燥，可行气，除胀，燥湿，为治脾胃气滞，湿阻之脘腹胀满、食少吐泻之佳品，对寒湿阻滞中焦者最为适宜。木香（E错）能通理三焦，行脾胃之气滞，故食积气滞尤宜。